一次成功接种可产生较长期免疫力的生物制品是
A. 灭活疫苗
B. 类毒素
C. 抗毒素
D. 免疫球蛋白
E. 减毒活疫苗

正确答案：E。减毒活疫苗